右心室出口周缘附着有
A. 二尖瓣
B. 三尖瓣
C. 主动脉瓣
D. 肺动脉瓣
E. 半月瓣

正确答案：D。肺动脉瓣

解析：肺动脉瓣（D对）附着于右心室出口周缘的肺动脉瓣环上。